（）中毒时，病人的动静脉血氧差会有明显下降
A. CO
B. NO
C. HCN
D. 氯气

正确答案：C。HCN

解析：本题考查氰化物中毒体征。氰化氢及其他氰化物的毒性，主要是其在体内解离出的氰离子（CN⁻）引起。CN⁻与细胞呼吸酶的亲和力最大，使细胞色素失去传递电子的能力，阻断呼吸链，使组织不能摄取和利用氧造成“细胞内窒息”。氰化物（C对ABD错）引起的窒息表现出的特点是：虽然血液为氧所饱和，但不能被组织利用。动静脉血氧差由正常的4.0%～5.0%降至1.0%～1.5%，静脉血呈动脉血的鲜红色。因此，氰化物中毒时，皮肤、黏膜呈樱桃红色。